对混合型血脂异常，必须联合应用他汀类和贝丁酸类，最佳的给药方法是
A. 早晨用贝丁酸，晚上用他汀
B. 早晨用他汀，晚上用贝丁酸
C. 早晚联合服用他汀和贝丁酸类
D. 晚上联合服用他汀类和贝丁酸类
E. 每隔2周交替服用贝丁酸和他汀

正确答案：A。早晨用贝丁酸，晚上用他汀

解析：本题考查联合用药。他汀类与贝丁酸类联合治疗，横纹肌溶解症发生率增加十倍，因此应设法规避联合用药的风险。两类药的半衰期约在12-18h内，可于晨起服用贝丁酸类药，睡前服用他汀类，或隔日交替服用（A对）。